某患者由印尼入境后2天，频繁腹泻，无腹痛及里急后重，伴有呕吐。最重要的检查是
A. 血常规
B. 尿常规
C. 电解质
D. 泻吐物悬滴检查
E. 以上均非

正确答案：D。泻吐物悬滴检查

解析：患者短时间内出现频繁腹泻，但无腹痛和里急后重，同时有呕吐，且有有印尼入境史，故考虑霍乱。故应做泻吐物悬滴检查，确定是否为霍乱弧菌（D对）。血常规（A错）、尿常规（B错）、电解质（C错）都不能检出霍乱弧菌。